3岁男童，开始出现频繁呛咳，后发生面部青紫，首先要考虑
A. 急性肺炎
B. 粟粒性肺结核
C. 气管异物
D. 药物中毒
E. 窒息

正确答案：C。气管异物

解析：本题考查气管异物的典型症状。当异物进入儿童气管、支气管或其深部时，可以引起患儿呛咳、面部青紫、呼吸困难，该儿童有以上症状，首先要考虑为气管异物（C对ABDE错），且应立即就医取出异物，如神志不清的患者或对异物吸入过程述说不清，容易导致漏诊，因此当婴幼儿出现上诉典型症状时，应及时就医进行影像学检查，并进行治疗。